下列药物中镇痛作用最强的是
A. 吗啡
B. 芬太尼
C. 哌替啶
D. 喷他佐辛
E. 美沙酮

正确答案：B。芬太尼

解析：芬太尼（B对）化学结构与哌替啶相似，主要激动μ型阿片受体，效价强度约为吗啡的80倍，镇痛强度为吗啡的100倍，可产生明显欣快、呼吸抑制和成瘾性，用于各种剧痛。吗啡（A错）对各种原因引起的疼痛均有强大的镇痛作用，但易成瘾，一般用于对其他镇痛药无效的疼痛，如骨折、严重创伤、烧伤以及晚期恶性肿瘤疼痛等。哌替啶（C错）是人工合成的阿片μ型受体激动药，其镇痛作用弱于吗啡，其效价强度相当于吗啡的1/10-1/8，镇痛的同时，可产生明显的镇静作用，可消除患者紧张烦躁情绪，少数患者有欣快感。喷他佐辛（D错）又名镇痛新，主要激动K阿片受体发挥镇痛作用，对μ型阿片受体有弱的拮抗作用，临床主要用于轻、中度疼痛的短期治疗。美沙酮（E错）为人工合成的μ型阿片受体激动剂，镇痛作用强度与吗啡相当，起效慢，临床用于各种剧痛，也用于吗啡和海洛因的脱毒治疗，是目前常用的阿片类的替代治疗药物。